湿温潮热不具有的症状是
A. 身热不扬
B. 午后热甚
C. 头身困重
D. 胸闷呕恶
E. 盗汗

正确答案：E。盗汗

解析：本题考查的是湿温潮热。湿温潮热不具有的症状是盗汗（E错，为本题正确答案）。潮热：潮热，指发热如潮有定时、按时而发或按时而热更甚的（一般多在下午），即为潮热。临床常见有三种情况。①阴虚潮热：每当午后或入夜即发热，属于“阴虚生内热”，且以五心烦热为特征，甚至有热自深层向外透发的感觉，故又称“骨蒸潮热”。常兼见盗汗、颧赤、口咽干燥、舌红少津等症。②湿温潮热：以午后热甚（B对）、身热不扬（A对）为特征。其病多在脾胃，因湿遏热伏，热难透达，所以身热不扬，初扪之不觉很热，扪之稍久则觉灼手。多伴有胸闷呕恶（D对）、头身困重（C对）、大便溏薄、苔腻等症。③阳明潮热：是由于胃肠燥热内结所致，因其常于日晡阳明旺时而热甚，故又称“日晡潮热”，常兼见腹满痛拒按、大便燥结、手足汗出、舌苔黄燥，甚则生芒刺等症。